牙拔除术手术区域的处理，哪项是错误的
A. 口腔为有菌环境但不能忽视无菌技术
B. 术前应尽量减少口腔内细菌数量
C. 所用敷料应为清洁敷料，但无须严格消毒处理
D. 所用器械因需反复使用，应严格消毒
E. 拔牙操作中，应注意预防交叉感染

正确答案：C。所用敷料应为清洁敷料，但无须严格消毒处理

解析：本题考查牙拔除术手术区域的处理。所用敷料应为清洁敷料，但仍需严格消毒处理（C错，为本题的正确答案），以避免污染伤口，促进愈合。任何手术都必须严格遵守无菌操作的原则，即使口腔本来就有很多细菌存在，也不能忽视无菌技术（A对），以尽可能减少术区污染继发感染机会。术前应尽量减少口腔内细菌数量（B对），最好先完成龈上洁治，术前口腔冲洗或含漱是有效减少细菌量的方法，也是为了尽可能达到无菌的条件。所用器械因需反复使用，应严格消毒（D对）可以避免交叉感染。拔牙操作中，应注意预防交叉感染（E对），注意对患者的防护和医生的自我防护。